治疗妊娠期高血压疾病，首选的解痉药是
A. 地西泮
B. 山莨菪碱
C. 硫酸镁
D. 阿托品
E. 冬眠合剂

正确答案：C。硫酸镁

解析：神经递质的分泌和骨骼肌的收缩均需要钙离子的参与，静脉注射硫酸镁（C对）可特异性拮抗钙离子的作用，从而抑制神经递质的分泌以及骨骼肌的而收缩，使中枢神经系统的感觉和意识暂时消失及骨骼肌松弛，从而产生抗惊厥作用，同时血中镁离子浓度过高时，可抑制血管平滑肌，使全身小血管扩张，血压下降，临床可用于妊娠高血压的抢救。地西泮（A错）属于苯二氮卓类镇定催眠药，具有镇定、催眠、抗惊厥的作用，可用于小二高热惊厥和药物中毒性惊厥。山莨菪碱（B错）也属于M受体阻断剂，可选择性解除血管痉挛，但无降压作用。阿托品（D错）属于M受体阻断剂，对多种内脏平滑肌具有松弛作用，多痉挛的平滑肌作用更加显著，临床可用于各种内脏绞痛，也具有改善微循环作用，但不用于高血压治疗。异丙嗪、氯丙嗪、哌替啶统称为冬眠合剂（E错），主要用于严重创伤和感染中毒，为争取其他措施赢得时间。